以下哪项不是局部振动病的主要表现
A. 周围神经末梢感觉障碍
B. 肢端血管痉挛
C. 上肢骨质改变
D. 上肢骨关节改变
E. 肌肉震颤

正确答案：E。肌肉震颤

解析：本题考查局部振动病。局部振动病又称手传振动病。手传振动可以引起外周循环（A对）功能改变，外周血管发生痉挛（B对），表现为皮肤温度降低，冷水负荷试验时皮温恢复时间延长，出现手传振动主要危害手臂振动病的典型临床表现发作性手指变白。振幅大，冲击力强的振动，往往引起骨、关节的损害，主要改变在上肢（CD对），亦可见手部肌肉萎缩、掌挛缩病等，目前未发现会引起肌肉震颤（E错，为本题正确答案）的症状。